形成骨上袋的牙槽骨吸收形式是
A. 水平型骨吸收
B. 垂直型骨吸收
C. 凹坑状吸收
D. 反波浪形骨吸收
E. 弧形骨吸收

正确答案：A。水平型骨吸收

解析：水平型吸收：是较常见的吸收方式。牙槽间隔、唇颊侧或舌侧的牙槽嵴顶呈水平吸收，而使牙槽嵴顶的高度降低，通常形成骨上袋，即牙周袋底在牙槽嵴顶的冠方。掌握“慢性牙周炎的病因，表现诊断及预后”知识点。